“寒极生热，热极生寒”所体现的阴阳相互关系是
A. 对立制约
B. 消长平衡
C. 互根互用
D. 相互转化
E. 交合感应

正确答案：D。相互转化

解析：本题考查阴阳的相互关系。“寒极生热，热极生寒”所体现的阴阳相互关系是相互转化（D对）。阴阳的相互转化：阴阳转化，是指在一定的条件下，阴或阳可以各自向其相反方向转化的质变形式，即由阴转阳、由阳转阴。阴阳的对立制约（A错）：阴阳对立，是指事物或现象中阴与阳两个方面，具有阴阳相反、相互制约的关系，又称“阴阳对待”。阴阳的消长平衡（B错）：阴阳的消长平衡，是指在一定的限度内，阴或阳的运动变化出现减少或增加的量变形式。消，即减少、消耗；长，即增多、增加。阴阳的互根互用（C错）：阴阳互根互用，是指事物或现象中相互对立的阴阳两个方面，具有相互依存、相互为用的关系，又称“阴阳互藏”。